夜晚，山坡表面散热量大，冷却快，气温低于谷地，冷空气下沉，形成
A. 山风
B. 谷风
C. 海风
D. 陆风
E. 城市热岛

正确答案：A。山风

解析：本题考查山风。夜晚，山坡表面散热量大，冷却快，气温低于谷地，冷空气下沉，形成山风（A对BCDE错）。